对妊娠子宫有兴奋作用，孕妇忌用的药物是
A. 乙胺嘧啶
B. 奎宁
C. 伯氨喹
D. 青蒿素
E. 氯喹

正确答案：B。奎宁